树胶肿多发病于
A. 梅毒一期
B. 梅毒二期
C. 梅毒三期
D. 梅毒四期
E. 梅毒五期

正确答案：C。梅毒三期

解析：树胶肿可发生于口腔任何部位，舌、硬腭、软腭常受侵犯，梅毒瘤或树胶肿是第三期梅毒所产生的肉芽组织，表现为有弹性的肿块，中心坏死，可有波动感，然后溃破，故上腭的梅毒瘤可导致软硬组织穿孔。掌握“梅毒的口腔表征”知识点。